枳术丸的功用是
A. 行气化滞
B. 消食导滞
C. 消痞除癥
D. 燥湿和胃
E. 健脾消痞

正确答案：E。健脾消痞

解析：枳术丸功效为健脾消痞（E对），方中枳实行气消痞，白术补中健脾，主治胸脘痞满，不思饮食之脾虚气滞，饮食停积证。